属于胰岛素增敏剂，具有噻唑烷结构，用于治疗2型糖尿病的药物是
A. 阿格列汀
B. 罗格列酮
C. 达格列净
D. 格列吡嗪
E. 那格列奈

正确答案：B。罗格列酮

解析：本题考查噻唑烷二酮类胰岛素增敏药。马来酸罗格列酮（B对）属于噻唑烷二酮类胰岛素增敏药，具有噻唑烷二酮的结构，用于治疗2型糖尿病。